涩肠止泻丸的功能
A. 健脾温肾，涩肠止泻
B. 调和肝脾，涩肠止泻
C. 收敛止泻，健脾和胃
D. 温肾固精，涩肠止泻

正确答案：C。收敛止泻，健脾和胃

解析：本题考查涩肠止泻丸的功能。涩肠止泻丸的功能为（C对）。涩肠止泻丸【功能】收敛止泻，健脾和胃。固本益肠片【功能】健脾温肾，涩肠止泻（A错）。固肠止泻丸【功能】调和肝脾，涩肠止泻（B错）。四神丸（片）【功能】温肾散寒，涩肠止泻（E错）。